用于治疗梅毒的药物是
A. 氯霉素
B. 青霉素
C. 羧苄青霉素
D. 四环素
E. 利福平

正确答案：B。青霉素

解析：本题考查青霉素。用于治疗梅毒的药物是青霉素（B对）。氯霉素（A错）为敏感菌株所致伤寒、副伤寒的首选药物。羧苄青霉素（C错）主要用于绿脓杆菌及部分变形杆菌、大肠杆菌所引起的中耳炎、肺炎、心内膜炎、膀胱炎、肾盂肾炎、手术后的脑膜炎、败血症、胆道感染、皮肤及软组织感染。使用前应作皮试，对青霉素过敏者本品亦忌用。四环素（D错）高浓度时具杀菌作用。利福平（E错）为利福霉素类半合成广谱抗菌药。